患儿乳食正常，体重增长正常，形体虚胖，大便4～5次/日，绿色稀便，伴有湿疹。应首先考虑的是
A. 大肠杆菌性肠炎
B. 病毒性肠炎
C. 金黄色葡萄球菌肠炎
D. 霉菌性肠炎
E. 生理性腹泻

正确答案：E。生理性腹泻

解析：生理性腹泻多见于6个月以内婴儿，外观虚胖，常有湿疹，生后不久即出现腹泻，除大便次数增多，无其他症状，食欲好，不影响生长发育，本证临床特点与之相符，故应首先考虑生理性腹泻（E对）。大肠杆菌性肠炎（A错）临床表现为体温不规则，38～40℃持续数天，每天腹泻10～20次，常为黄绿色水样便，混有少量黏液，可有腥臭味，多有恶心呕吐，可有脱水及酸中毒表现，本证临床表现与之不符。小儿病毒性肠炎（B错）多由轮状病毒引起，其临床表现为起病急，常伴有发热和上呼吸道感染症状，先吐后泻，大便次数多，量多，水分多，黄色水样便或蛋花样便。金黄色葡萄球菌肠炎（C错）因长期使用抗生素引起的肠道菌群失调所致，轻者大便次数稍多，为黄绿色糊状便，重者大便次数频繁，每日可达数十次，大便呈暗绿色水样便，外观像海水，黏液多，有腥臭味，有时可排出伪膜。霉菌性肠炎（D错）常继发于鹅口疮，大多发生在应用抗生素治疗后，轻者腹泻水样，重者水样便中可见伪膜，除消化道症状外，尚可见皮肤感染征象。